以下关于药物不良反应的描述中，正确是
A. 药物不良反应是指在正常用量、用法下发生的
B. 药物不良反应就是药物本身的毒副作用
C. 药物的不良反应专指药物本身的“三致”作用
D. 大剂量服用催眠药而致中毒也是药物不良反应
E. 将氯化钾快速静脉注射而致死亡是药物不良反应

正确答案：A。药物不良反应是指在正常用量、用法下发生的

解析：不良反应：为了预防、诊断、治疗疾病或改变人体的生理功能，在正常用法、用量下服用药物后机体所出现的非期望的有害反应。掌握“药品不良反应概念、报告、处置与法律责任”知识点。